哪项不是血液性缺氧的血气变化
A. 动脉血氧分压正常
B. 动-静脉氧含量差增大
C. 动-静脉氧含量差减小
D. 血氧容量降低
E. 血氧饱和度正常

正确答案：B。动-静脉氧含量差增大

解析：动脉血氧分压正常（A对）、动脉血氧容量正常或降低（D对）、动脉血氧饱和度正常或降低（E对）、动-静脉血氧含量差降低（C对B错，为本题正确答案）是血液性缺氧的血氧变化特点。